肾可分为
A. 上段、前段、后段、下段
B. 上段、上前段、上后段、下段
C. 上段、下前段、下后段、下段
D. 上段、上前段、下前段、下段、后段
E. 上段、上后段、下后段、前段、下段

正确答案：D。上段、上前段、下前段、下段、后段

解析：肾动脉的5个分支在肾内呈节段性分布，称肾段动脉。每支肾段动脉分布到一定区域的肾实质，称为肾段。每个肾有五个肾段，即上段、上前段、下前段、下段和后段（D对）。